天南星的入药部位
A. 根
B. 根及根茎
C. 块茎
D. 鳞茎
E. 球茎

正确答案：C。块茎

解析：本题考查的是天南星的入药部位。天南星的入药部位块茎（C对）。天南星：【来源】为天南星科植物天南星、异叶天南星或东北天南星的干燥块茎。入药部位为根（A错）的中药有牛膝、川牛膝、商陆、银柴胡、白芍、赤芍、板蓝根、地榆、苦参、葛根、粉葛、黄芪、西洋参、白芷、当归等。入药部位为根及根茎（B错）中药有大黄、山豆根、甘草、三七、龙胆、紫菀等。入药部位为鳞茎（D错）中药有川贝母、浙贝母等。入药部位为球茎（E错）中药，2022年考试指南未明确说明。